患者王某在参加聚餐3天后，突然出现发热、腹痛和腹泻，开始为水样便，1天后转为黏液脓血便，里急后重感明显。应考虑的诊断和检查方法是
A. 霍乱；取脓血便直接镜检
B. 沙门菌食物中毒；取剩余食物分离致病菌
C. 细菌性痢疾；取脓血便分离肠道致病菌
D. 伤寒；取脓血便进行免疫荧光检测
E. 葡萄球菌食物中毒；取剩余食物分离致病菌

正确答案：C。细菌性痢疾；取脓血便分离肠道致病菌

解析：细菌性痢疾；取脓血便分离肠道致病菌。细菌性痢疾简称菌痢。是志贺菌属（痢疾杆菌）引起的肠道传染病。临床表现主要有发冷、发热、腹痛、腹泻、里急后重、排粘液脓血样大便。掌握“细菌性痢疾”知识点。